判定下列哪一项不属于职业病的范围
A. 伐木工人的森林脑炎和手臂振动病
B. 凿岩工人的硅沉着病
C. 石墨工人的炭黑肺尘埃沉着病
D. 铅作业工人的消化性溃疡
E. 煤矿井下工人发生的滑囊炎

正确答案：D。铅作业工人的消化性溃疡